男，30岁，约一年时间孤僻、寡言，近期由于被上级批评后出现失眠，不上班并紧闭门窗，声称有人监视自己，在家中不敢谈话，说家中已被安装窃听器，公安局也要逮捕自己，不吃妻子做的饭食，认为妻子已同他人合伙在饭菜中放了毒药。因此殴打妻子。本病例最可能的诊断是
A. 精神分裂症紧张型
B. 精神分裂症偏执型
C. 抑郁症
D. 反应性精神病
E. 躁狂症

正确答案：B。精神分裂症偏执型

解析：青年男性患者，既往约一年时间孤僻、寡言，近期出现失眠，不上班并紧闭门窗，声称有人监视自己，在家中不敢谈话，说家中已被安装窃听器，公安局也要逮捕自己，不吃妻子做的饭食，认为妻子已同他人合伙在饭菜中放了毒药（患者认为自己被某些人或某些组织进行迫害，投毒、监视），最可能的诊断为精神分裂症偏执型（B对）。精神分裂症紧张型（A错）患者表现为紧张性木僵和紧张性兴奋交替出现。抑郁症（P110-P111）（C错）表现为情感低落、兴趣缺乏、快感缺失、思维迟缓、失眠障碍等躯体症状。躁狂症（P112-P113）（E错）表现为情感高涨、思维奔逸、活动增多、夸大观念及夸大妄想、睡眠需求减少等。反应性精神病（P160-P161）（D错）是在强烈精神刺激下急剧起病表现为反应性躁狂、反应性抑郁、反应性木僵、反应性妄想。